腹主动脉
A. 腹膜间位器官
B. 平第5腰椎下缘分为左右髂总动脉
C. 脏支远较壁支粗大
D. 后方有胰．脾．十二指肠水平部和小肠系膜根
E. 无

正确答案：C。脏支远较壁支粗大

解析：腹主动脉平第4腰椎下缘分为左右髂总动脉（B错）。脏支远较壁支粗大（C对）。